又称习惯性脱位的是
A. 颞下颌关节复发性脱位
B. 颞下颌关节急性前脱位
C. 颞下颌关节急性后脱位
D. 颞下颌关节陈旧性脱位
E. 颞下颌关节强直

正确答案：A。颞下颌关节复发性脱位

解析：复发性脱位颞下颌关节前脱位反复发作，造成患者言语、进食困难，又称习惯性脱位。掌握“颞下颌关节脱位”知识点。